肾病综合征激素抵抗型首选的治疗药是
A. 麦考酚吗乙酯
B. 双嘧达莫
C. 呋塞米
D. 泼尼松
E. 环磷酰胺

正确答案：E。环磷酰胺

解析：该题主要考查肾病综合征的治疗。肾病综合征首选用药应选糖皮质激素类药物，而题目所说为激素抵抗型的首选用药，即为细胞毒类药物，而环磷酰胺为最常用的细胞毒性药物（E对）。